下列哪种因素可使人群易感性降低
A. 新生儿增加
B. 获得性免疫力自然减退
C. 易感人口迁入
D. 隐性感染后免疫人口增加
E. 以上均不对

正确答案：D。隐性感染后免疫人口增加

解析：本题考查可使人群易感性降低的因素。可使人群易感性降低的因素有：1.计划免疫：按规定的免疫程序，有计划地对易感人群进行预防接种，是降低人群易感性的重要措施。2.传染病流行：一次传染病流行后，大部分易感者由于感染而获得免疫力，即人群免疫力得以提高，此时该病维持在较低发病水平。3.隐性感染后免疫人口增加（D对）：通过隐性感染可能获得免疫，而使人群易感性降低，但此种免疫一般不甚牢靠。新生儿增加（A错）、获得性免疫力自然减退（B错）、易感人口迁入（CE错）均是引起人群易感性升高的主要因素。